消化性溃疡并发幽门梗阻，应首选的治疗措施是
A. 阿托品加输液
B. 洛赛克加输液
C. 抗生素加消食中药
D. 禁食、胃肠减压、补液
E. 服中药消导化滞

正确答案：D。禁食、胃肠减压、补液

解析：消化性溃疡并发幽门梗阻，应首选的治疗措施是禁食、胃肠减压、补液、解除梗阻和消除溃疡（D对）。阿托品加输液（A错）、洛赛克加输液（B错）、抗生素加消食中药（C错）、服中药消导化滞（E错）不是消化性溃疡并发幽门梗阻的首选治疗措施。